已知空白基质栓重2.0g，鞣酸置换价为1.6。若制备每粒含鞣酸0.2g的栓剂100粒，则所需基质为
A. 40.0g
B. 160.0g
C. 168.0g
D. 180.0g
E. 187.5g

正确答案：E。187.5g

解析：本题考查置换价的计算公式。已知空白基质栓重2.0g，鞣酸置换价为1.6。若制备每粒含鞣酸0.2g的栓剂100粒，则所需基质为187.5g（E对）。置换价（DV）系指药物的重量与同体积基质的重量之比值。栓剂模型的容积是固定的，通常的1g或2g栓剂是指纯基质（常为可可豆脂）栓的重量，由于药物与基质相对密度不同，加入药物所占体积不一定是等重量基质体积，为使栓剂含药量准确，必须测定置换价，从而准确计算基质用量。测定方法如下：制纯基质栓，称其平均重量为G，另制药物含量为X%的含药栓，得平均重量为M，每粒平均含药量为W=M*X%，则可计算某药物对某基质的置换价（f）。置换价在栓剂生产中对保证投料的准确性有重要意义。置换价（f）的计算公式为：f=W/G-（M-W）。式中，G为纯基质栓每粒平均重，M为含药栓每粒平均重，M-W为含药栓中基质的重量，G-（M-W）为两种栓中基质的重量之差，即与药物同容积的基质的重量。